某人乙肝抗原抗体检查结果为HBsAg(-)抗-HBs(+)抗HBcIgG(+)抗HBe(+),应判断为
A. 乙肝病毒携带者
B. 乙肝急性期病人
C. 乙肝慢性期病人
D. 乙肝恢复期病人，传染性弱
E. 乙肝恢复期病人，传染性强

正确答案：D。乙肝恢复期病人，传染性弱

解析：患者乙肝抗原抗体结果抗HBe(+)表示病毒复制多处于静止状态，传染性降低，乙肝恢复期病人抗-HBs和抗HBcIgG都呈阳性，故HBsAg(-)抗-HBs(+)抗HBcIgG(+)抗HBe(+)判断为乙肝恢复期病人，传染性弱（D对）。